患者月经提前，心悸怔忡，健忘不眠，食少体倦，面色萎黄，舌淡苔薄白，脉细弱者，治疗应选用的方剂是
A. 牡蛎散
B. 归脾汤
C. 补中益气汤
D. 四物汤
E. 黄土汤

正确答案：B。归脾汤

解析：“心悸怔忡，健忘不眠”提示心血暗耗，神无所主，意无所藏；“食少体倦，面色萎黄，舌淡苔薄白，脉细弱”提示脾虚运化无力，化源不足，气血衰少；“月经提前”乃脾气亏虚不能摄血所致，证当属心脾气血两虚证，治以益气补血，健脾养心，方选归脾汤（B对）。方中以人参、黄芪、白术、甘草甘温之品补脾益气以生血，使气旺而血生；当归、龙眼肉甘温补血养心；茯苓（多用茯神）、酸枣仁、远志宁心安神；木香辛香而散，理气醒脾，与大量益气健脾药配伍，复中焦运化之功，又能防大量益气补血药滋腻碍胃，使补而不滞，滋而不腻；用法中姜、枣调和脾胃，以资化源。牡蛎散功用为主治（A错）。补中益气汤功用为补中益气，升阳举陷，主治脾胃气虚证（C错）。四物汤功用为补血调血，主治营血虚滞证（D错）。黄土汤功用为温阳健脾，养血止血，主治脾阳不足，脾不统血证（E错）。